王某，48岁，建筑工人，因牙关紧闭、四肢痉挛而入院。8天前，右脚被铁钉扎伤，伤口深，但几日后自愈。5日后，右腿有些麻木和疼痛，咀嚼不便，吞咽困难，最后全身抽搐，四肢痉挛。入院诊断为破伤风，请问下述哪项是最佳治疗原则
A. 注射青霉素
B. 注射破伤风抗毒素和青霉素
C. 注射破伤风抗毒素和白百破疫苗
D. 注射破伤风抗毒素
E. 注射白百破疫苗和青霉素

正确答案：B。注射破伤风抗毒素和青霉素

解析：防治原则：①正确处理伤口：清创并对伤口用过氧化氢溶液（H2O2）冲洗创面以消除厌氧环境。②局部或全身应用抗生素：如大剂量使用青霉素，防止伤口局部细菌的生长繁殖。③注射破伤风抗毒素（TAT）：中和游离的破伤风外毒素，对患者进行紧急预防接种和对症治疗。④应用破伤风类毒素进行预防接种：中国计划免疫规程中规定使用白百破（DPT）三联疫苗对儿童进行计划免疫，另对军人和易受外伤的高危人群，可提前注射破伤风类毒素进行预防。掌握“厌氧芽胞梭菌”知识点。